女，28岁。停经19周，剧烈腹痛1天，超声提示单胎妊娠合并子宫肌壁间肌瘤。考虑该肌瘤为
A. 囊性变
B. 红色样变
C. 玻璃样变
D. 肉瘤样变
E. 钙化

正确答案：B。红色样变

解析：患者为育龄期妇女，停经19周（疑为早孕），剧烈腹痛1天，超声提示单胎妊娠合并子宫肌壁间肌瘤（红色样变多见于妊娠期或产褥期，患者可有剧烈腹痛伴恶心、呕吐、发热，白细胞计数升高），考虑该肌瘤为红色样变（B对）。玻璃样变（C错）、囊性变（A错）、肉瘤样变（D错）、钙化（E错）无特殊临床表现。